2008年共发生200例某病病人，在2008年年初已知有800例病人，年内因该病死亡40例，年中人口数1000万，如果该病的发生和因该病死亡的事件均匀分布在全年中，则2008年期间该病的死亡率（1/10万）是
A. 2.0
B. 8.0
C. 10
D. 1.6
E. 0.4

正确答案：E。0.4

解析：本题考查死亡率。2008年共发生200例某病病人，在2008年年初已知有800例病人，年内因该病死亡40例，年中人口数1000万，如果该病的发生和因该病死亡的事件均匀分布在全年中，则2008年期间该病的死亡率（1/10万）是0.4（E对）。死亡率=单位时间死亡个体数/单位时间平均种群数量×K，其中K=100%、1000‰、10000/万或100000/10万等。死亡率=40/100×100000/10万=0.4。